根据《处方药与非处方药分类管理办法（试行）》，下列叙述正确的是
A. 处方药需经批准方可在中央电视台进行广告宣传
B. 非处方药无需批准即可直接在《中国医药报》上进行广告宣传
C. 处方药只可在医疗机构使用
D. 非处方药经批准可在《光明日报》上进行广告宣传
E. 非处方药的标签和说明书须经省级药品监督管理部门批准

正确答案：D。非处方药经批准可在《光明日报》上进行广告宣传

解析：本题考查处方药与非处方药分类管理办法。根据《处方药与非处方药分类管理办法（试行）》，下列叙述正确的是非处方药经批准可在《光明日报》上进行广告宣传（D对）。处方药只准在专业性医药报刊进行广告宣传（A错），非处方药经审批（B错）可以在大众传播媒介进行广告宣传。处方药必须凭执业医师或执业助理医师处方才可调配、购买和使用（C错）。非处方药的标签和说明书须经国家药品监督管理局批准（E错）。